某男，20岁，因饮食不洁导致痢疾，症见大便脓血里急后重，发热腹痛，舌淡红，苔黄腻，脉滑数。医师诊为大肠湿热，处方为黄连、木香，水煎服。医师在方中选用黄连是因其除湿热燥湿外，又能
A. 凉血活血
B. 收敛止泻
C. 泻下通便
D. 渗湿止泻
E. 泻火解毒

正确答案：E。泻火解毒

解析：本题考查的是黄连的功效。医师在方中选用黄连是因其除湿热燥湿外，又能泻火解毒（E对）。黄连：【功效】清热燥湿，泻火解毒。紫草：【功效】凉血活血（A错），解毒透疹。石榴皮：【功效】涩肠止泻，止血，杀虫。石榴皮长于收敛止泻（B错），又能杀虫，治虫积腹痛。虎杖：【功效】利湿退黄，清热解毒，活血祛瘀，化痰止咳，泻下通便（C错）。薏苡仁：【功效】利水渗湿，健脾止泻（D错），除痹，清热排脓。